下列不属于公共卫生监测系统的质量评价指标的是
A. 敏感性
B. 代表性
C. 及时性
D. 灵活性
E. 可接受性

正确答案：E。可接受性

解析：本题考查公共卫生监测系统的质量评价指标。对公共卫生监测系统的质量评价，包括完整性、敏感性（A对）、特异性、及时性（C对）、代表性（B对）、简单性、灵活性（D对）等多个方面。可接受性（E错，为本题正确答案）是公共卫生监测系统的效益评价指标。